在酸性溶液中与三氯化铁反应，检查的杂质是
A. 硫酸阿托品中的莨菪碱
B. 硝酸士的宁中的马钱子碱
C. 盐酸吗啡中的罂粟酸
D. 硫酸奎宁中的其它生物碱
E. 盐酸麻黄碱中的有关物质

正确答案：C。盐酸吗啡中的罂粟酸